编制糖尿病食谱时，每1份食品交换份的任何食物均能提供大约相等的
A. 营养素
B. 能量
C. 糖类
D. 蛋白质
E. 降糖效果

正确答案：B。能量

解析：本题考查糖尿病食谱编制方法。编制糖尿病食谱时，每1份食品交换份的任何食物均能提供大约相等的能量（B对ACDE错）。